药用部位为干燥成熟种仁的药材是
A. 鹤虱
B. 酸枣仁
C. 金樱子
D. 肉豆蔻
E. 桑椹

正确答案：D。肉豆蔻

解析：本题考查的是常用果实及种子类中药的药用部位。药用部位为干燥成熟种仁的药材是肉豆蔻（D对）。果实及种子在植物体中是两种不同的器官，但在商品药材中常未严格区分。果实大多包含着种子，与种子一起入药，如马兜铃、栀子等；亦有只用种子，如决明子、沙苑子等；有的以果实贮存、销售，临用时再剥去果皮取出种子入药，如巴豆、砂仁等。果实类中药的药用部位通常是采用完全成熟的果实，如五味子、山楂；近成熟或未成熟的果实，如吴茱萸、木瓜、枳壳；少数为幼果，如枳实、青皮。多数采用完整的果实，如枸杞子、五味子等；有的采用果实的一部分，如陈皮、大腹皮为果皮，甜瓜蒂为带有部分果皮的果柄，柿蒂为果实上的宿萼，橘络、丝瓜络为中果皮部分的维管束组织。有的采用整个果穗，如桑椹（E错）等。种子类中药的药用部位大多是完整的成熟种子，包括种皮和种仁两部分；种仁又包括胚乳和胚。也有少数用种子的一部分，如绿豆衣为种皮，肉豆蔻衣、龙眼肉为假种皮，肉豆蔻为除去种皮的种仁，莲子心为幼叶及胚根。极少数为成熟种子的加工品，如大豆黄卷为发芽种子（经发芽干燥的加工品），淡豆豉为发酵加工品。酸枣仁（B错）：【来源】为鼠李科植物酸枣的干燥成熟种子。金樱子（C错）：【来源】为蔷薇科植物金樱子的干燥成熟果实。鹤虱（A错）的药用部位，2022年考试指南未明确说明。